下列关于生精小管的描述中，错误的是
A. 位于睾丸实质的锥形小叶内
B. 为细长而弯曲的小管
C. 为产生精子的场所
D. 进入睾丸纵隔，互相吻合成睾丸网
E. 管壁上皮外有基膜

正确答案：D。进入睾丸纵隔，互相吻合成睾丸网

解析：进入睾丸纵隔，互相吻合成睾丸网（D错，为本题正确答案）为生精小管汇合成的精直小管。